虚人感冒应选用的方法是
A. 急则治其标
B. 缓则治其本
C. 标本同治
D. 先扶正后祛邪
E. 先祛邪后扶正

正确答案：C。标本同治

解析：虚人感冒即体虚感冒，是指患者在感冒时伴有某些“正气虚弱”的表现。该病患者大多由于脾肺气虚、卫外不固而易于感受外邪。体虚感冒会反复发生。正如明代《证治汇补·伤风》中所说：“如虚人伤风，屡感屡发”。中医治疗体虚感冒有较好的效果。其治法不是单纯地祛邪解表而要兼用补法，不仅重视对患者病症的治疗，还要注意对患者病后的调理以及病前的预防。即标本同治（C对）。